患者，女，14岁，诊断为原发性痛经。该患者宜优先采用的治疗方案是
A. 服用非甾体抗炎药
B. 性激素周期疗法
C. 扩张宫颈，以利经血流出
D. 雄激素周期疗法
E. 服用弱阿片类药物

正确答案：A。服用非甾体抗炎药

解析：本题考查痛经治疗药。原发性痛经患者宜优先采用的治疗方案是服用非甾体抗炎药（A对）。治疗原发性痛经非甾体抗炎药、局部热疗和口服避孕药是首选。如果不需要避孕，从成本和方便性的角度来看，非甾体抗炎药是首选。如果需要避孕，考虑成本、依从性和不良反应，可以考虑激素类药物。